23岁，女性，妊娠32周，腹部撞击后，持续性腹痛，少量出血，既往产检健康，脉搏100次/分，呼吸22/分，血压90/60mmHg，痛苦表情，宫底位于剑突下3横指，子宫轮廓清楚，胎心102次/分，宫口未开。确诊首选检查
A. 缩宫激素试验
B. 胎心电子监护
C. 超声
D. MRI
E. 腹部穿刺

正确答案：C。超声

解析：青年女性患者，考虑可能的诊断为胎盘早剥，其确诊首选检查为超声（C对），其可协助了解胎盘的部位及胎盘早剥的类型，并可明确胎儿大小及存活情况。缩宫激素试验（A错）主要是用于预测胎儿宫内储备能力的一种方式，了解胎盘与宫缩时一过性缺氧的负荷变化，不作为确诊胎盘早剥的首选检查。胎心电子监护（B错）协助判断胎儿的宫内状况，电子胎心监护可出现胎心基线变异消失、变异减速、晚期减速、正弦波形及胎心率缓慢等。MRI（D错）、腹部穿刺（E错）一般不用于胎盘早剥的检查。